下列哪种为必需脂肪酸
A. 花生四烯酸
B. EPA
C. DHA
D. 亚油酸
E. 油酸

正确答案：D。亚油酸